附着于左房室口的是
A. 窦房结
B. 室间隔
C. 三尖瓣复合体
D. 左、右冠状动脉开口
E. 二尖瓣

正确答案：E。二尖瓣

解析：二尖瓣（E对）附着于左心室的左房室口周围的二尖瓣环上。